肌肤冷汗淋漓，汗质稀淡，神情淡漠，手足厥冷属于
A. 亡阳证
B. 亡阴证
C. 阴证
D. 阳证
E. 寒证

正确答案：A。亡阳证

解析：由于阳气极度衰微，失去温煦、固摄、推动的作用，故可见冷汗淋漓，神情淡漠，手足厥冷的症状；辨证为亡阳证（A对）。亡阴证表现为汗热而黏，如珠如油，身热肢温，虚烦躁扰，呼吸气急，口渴饮冷，小便极少，皮肤皱瘪，目眶凹陷，面赤颧红，唇舌干焦，脉细数疾，按之无力（B错）。阴证表现为面色苍白，精神萎靡，畏冷肢凉，倦怠无力，语声低怯，口淡不渴，小便清长或短少，大便溏泄，舌淡胖嫩，脉沉迟、微弱、细（C错）。阳证表现为面色红赤，恶寒发热，肌肤灼热，神烦，躁动不安，语声粗，呼吸气粗，喘促痰鸣，口干渴饮，大便秘结，小便涩痛，短赤，舌质红绛，苔黄黑生芒刺，脉象浮数，洪大，滑实（D错）。寒证表现为恶寒，或畏寒喜暖，肢冷喜卧，局部冷痛，口淡不渴，痰、涕、涎液清稀，小便清长，大便溏薄，面色白，舌质淡，苔白而润，脉紧或迟等（E错）。